白茅根的功效是
A. 温经止血
B. 滋阴止血
C. 收敛止血
D. 凉血止血
E. 补血止血

正确答案：D。凉血止血

解析：本题考查的是白茅根的功效。白茅根的功效是凉血止血（D对）。白茅根：【功效】凉血止血，清热生津，利尿通淋。炮姜：【功效】温经止血（A错），温中止痛。龟甲：【功效】滋阴潜阳，益肾健骨，养血补心，凉血止血（B错）。棕榈炭：【功效】收敛止血（C错）。阿胶：【功效】补血止血（E错），滋阴润燥。